假设检验时，若α=0.05，则下列关于检验结果的说法正确的是
A. 若P大于0.05，则拒绝H₀，此时可能犯I型错误
B. 若P小于0.05，则拒绝H₀，此时可能犯Ⅱ型错误
C. 若P小于0.05，则不拒绝H₀，此时可能犯I型错误
D. 若P小于0.05，则不拒绝H₀，此时可能犯Ⅱ型错误
E. 若P大于0.05，则不拒绝H₀，此时可能犯Ⅱ型错误

正确答案：E。若P大于0.05，则不拒绝H₀，此时可能犯Ⅱ型错误